出现足的背屈无力,伸拇,伸趾障碍是损伤了
A. 坐骨神经
B. 股神经
C. 腓总神经
D. 腓浅神经
E. 腓深神经

正确答案：E。腓深神经

解析：腓深神经（E对）分布于小腿前群肌、足背肌及第1、2趾相对缘的皮肤，损伤后导致足的背屈无力,伸拇,伸趾障碍。